患者，女，46岁。月经紊乱近1年，头晕耳鸣，腰膝酸软，时有烘热汗出，舌红少苔，脉细数。治疗应首选的方剂是
A. 右归丸
B. 杞菊地黄丸
C. 右归丸合二至丸
D. 丹栀逍遥丸
E. 二仙汤合二至丸

正确答案：B。杞菊地黄丸

解析：患者为中年女性，处在绝经期前后，出现月经紊乱近1年，头晕耳鸣，腰膝酸软，时有烘热汗出，可判断患者为肝肾阴虚证，又结合舌苔脉象舌红少苔，脉细数符合肝肾阴虚证（B对）。肾阴阳两虚证证候∶经断前后，时而烘热汗出，时而畏寒肢冷，腰酸乏力，头晕耳鸣，浮肿便溏，月经紊乱，月经过多或过少，淋沥不断，或突然暴下如注，经色淡或暗。舌淡苔薄，脉沉弱。治法∶滋阴补肾，调补冲任。方药∶二仙汤合二至丸（E错）。心肝火旺证 证候∶经前或经期狂躁易怒，头痛头晕，口苦咽干，面红目赤，口舌生疮，溲黄便干，经行吐衄。舌质红苔薄黄，脉弦滑数。治法∶疏肝解郁，清热调经。方药∶丹栀逍遥散（D错）。右归丸具有温补肾阳，填精止遗之功效。用于肾阳不足，命门火衰，腰膝酸冷，精神不振，怯寒畏冷，阳痿遗精，大便溏薄，尿频而清（AC错）。